关于固体分散物的说法，错误的是
A. 固体分散物中药物通常是以分子、胶态、微晶或无定形状态分散
B. 固体分散物作为制剂中间体可以进一步制备成颗粒剂、片剂或胶囊剂
C. 固体分散物不易发生老化现像
D. 固体分散物可提高药物的溶出度
E. 固体分散物利用载体的包装作用，可廷缓药物的水解和氧化

正确答案：C。固体分散物不易发生老化现像

解析：本题考查固体分散物。固体分散物很容易发生老化现象（C错，为本题正确答案）。固体分散物中药物通常以分子、胶态、微晶或无定形状态分散（A对）；固体分散物作为中间体还可以进一步制备成颗粒剂、片剂，胶囊剂等（B对）；固体分散物中可提高难溶性药物的溶出度（D对）；固体分散物利用载体的包装，可以延缓药物的水解和氧化（E对）；